患者对经治医生不满意时，可以重新选择医生属于
A. 患者的权利
B. 患者的义务
C. 医生的权利
D. 医生的义务
E. 患者和医生共同的义务

正确答案：A。患者的权利